女孩，5岁。因间断发热伴痉挛性咳嗽20天来诊。体温38℃，神志清。慢性病容，右眼结膜充血。内眦部有一疱疹，咽部有充血，右颈部可触及豌豆大小淋巴结，无明显压痛，心、肺无异常。肝肋下1.0cm，胸透肺门可见3cm×3cm阴影，外周血白细胞5.6×10⁹/L，淋巴细胞0.7。该患儿最大可能地诊断是
A. 百日咳合并肺炎感染
B. 支原体肺炎
C. 支气管淋巴结结核
D. 真菌性肺炎
E. 肺门淋巴肉瘤

正确答案：C。支气管淋巴结结核

解析：学龄前儿童，间断发热伴痉挛性咳嗽20天来诊，体温38℃（正常值为36℃～37℃，发热），神志清，慢性病容，右眼结膜充血，内眦部有一疱疹，咽部有充血，右颈部可触及豌豆大小淋巴结，无明显压痛，肝肋下1.0cm（提示肝脏增大），胸透肺门可见3cm×3cm阴影（支气管淋巴结结核的典型X线表现），外周血白细胞5.6×10⁹/L（正常值为4～10×10⁹/L），淋巴细胞0.7（正常值为0.2～0.4，淋巴细胞增高），根据患儿的临床症状、体征及实验室检查，考虑最可能的诊断为支气管淋巴结结核（C对），本病的结节型的胸部X线表现为肺门区域圆形或卵圆形致密阴影。肺炎（ABD错）白细胞及中性粒细胞增高。肺门淋巴肉瘤（E错）是恶性肿瘤，早期没有明显的症状。